软脊膜
A. 含有丰富的神经
B. 形成齿状韧带
C. 紧贴于颅骨内表面
D. 薄且透明、无血管分布
E. 与硬脑膜之间形成硬膜下隙

正确答案：B。形成齿状韧带

解析：脑和脊髓的表面包有三层被膜，由外向内依次为硬膜、蛛网膜和软膜，软脊膜是脊髓的最内层被膜，而脑蛛网膜与硬脑膜之间或硬脊膜与脊髓蛛网膜之间才有硬膜下隙（E错），软脊膜薄而富含血管（AD错），紧贴脊髓表面（C错）。软脊膜在脊髓两侧，脊神经前、后根之间形成齿状韧带（B对），该韧带呈齿状，其尖端附于硬脊膜。